巴载天除能补肾阳、强筋骨外，又能
A. 固精缩尿
B. 续筋骨
C. 祛风湿
D. 润肠通便
E. 温脾止泻

正确答案：C。祛风湿

解析：本题考查巴戟天的功效。巴载天除能补肾阳、强筋骨外，又能祛风湿（C对）。巴戟天【功效】补肾阳，强筋骨，祛风湿。补骨脂【功效】补肾壮阳，固精缩尿（A错），温脾止泻，纳气平喘。续断【功效】补肝肾，行血脉，续筋骨（B错）。决明子【功效】清肝明目，润肠通便（D错）。益智仁【功效】暖肾固精缩尿，温脾止泻（E错）摄唾。